患者，男，69岁，痴呆病史5年。近期查肾功能显示：肌酐清除率20ml/min。宜选用的药物是
A. 恩他卡朋双多巴
B. 多奈哌齐
C. 复方左旋多巴
D. 苯海索
E. 普拉克索

正确答案：B。多奈哌齐

解析：本题考查痴呆的药物治疗。常用于治疗痴呆症的治疗药物有胆碱酯酶抑制剂（多奈哌齐（B对）、卡巴拉汀、加兰他敏）以及美金刚。